男，50岁。自幼起常咳嗽、咳痰，近2年来症状加重，1周前咯鲜血1次，量约100ml。查体：左下肺可闻及湿啰音。胸部X线片示左下肺纹理粗乱。为明确诊断首选的检查是
A. 肺功能
B. 支气管镜
C. 胸部高分辨CT
D. 支气管动脉造影
E. 支气管碘油造影

正确答案：C。胸部高分辨CT

解析：患者中老年男性，自幼起常咳嗽、咳痰（幼年既有症状符合支扩的起病特点），近2年来症状加重，1周前咯鲜血1次，量约100ml（支扩的主要症状）。查体：左下肺可闻及湿啰音（支扩体征）。胸部X线片示左下肺纹理粗乱（支扩常见影像学表现）。结合患者病史、临床表现及相关辅助检查，即可初步诊断该患者为支气管扩张，对于支气管扩张患者应首选高分辨CT检查进一步明确诊断（C对）。肺功能主要用于慢支慢阻肺的诊断（A错）；支气管镜主要用于明确肺癌诊断（B错）；支气管动脉造影主要用于肺栓塞的明确诊断（D错）。支气管碘油造影为确诊支气管扩张的创伤性检查。